不属于淋巴结的结构和功能的是
A. 输入淋巴管由淋巴结的凹侧即淋巴结的门进入淋巴结
B. 多聚集、成群分布于人体的较隐蔽处
C. 在四肢多位于关节的屈侧及窝内
D. 在内脏多位于器官门附近或大血管分支的周围
E. 有过滤淋巴、产生淋巴细胞和浆细胞、参与机体的免疫应答的作用

正确答案：A。输入淋巴管由淋巴结的凹侧即淋巴结的门进入淋巴结

解析：输入淋巴管由淋巴结凸侧进入淋巴结，凹侧即淋巴结门进出的是输出淋巴管（A错，为本题正确答案）。淋巴结多聚集、成群分布在较隐蔽处（B对），在四肢多位于关节的屈侧及窝内（C对），在内脏多位于器官门附近或大血管分支的周围（D对）。淋巴结的功能由过滤淋巴、产生淋巴细胞（包括浆细胞）参与机体的免疫应答的作用（E对）。